下列哪项不是乳癌的临床表现
A. 肿块生长速度较快
B. 癌块表面皮肤凹陷
C. 肿块表面光滑，活动度好
D. 橘皮样外观
E. 最早表现为无痛，单发，质硬，界限不清小肿块

正确答案：C。肿块表面光滑，活动度好

解析：乳腺癌为恶性病，多呈现浸润性生长，表面粗糙，与周围组织分界不清楚（C错，为本题正确答案）。癌细胞生长不受机体的正常调控，为自主性增生，生长速度快（A对）。癌组织侵犯Cooper韧带，可使其缩短而导致癌块表面皮肤凹陷（B对），呈现“酒窝征”。癌细胞堵塞皮下淋巴管网，导致局部淋巴回流障碍，出现真皮水肿，皮肤呈现橘皮样外观（D对）。早期乳腺癌常是无痛，单发，质硬，边界不清的小肿块（E对）。